肉苁蓉饮片的性状鉴别特征有
A. 为类方形切片
B. 表面棕褐色或灰棕色，有的可见肉质鳞叶
C. 切面黄白色
D. 切面有点状维管束排列成不规则的波状环纹或成条状而散列
E. 气微，味甜、微苦

正确答案：B、D、E。表面棕褐色或灰棕色，有的可见肉质鳞叶；切面有点状维管束排列成不规则的波状环纹或成条状而散列；气微，味甜、微苦

解析：本题考查的是中药材的性状鉴别。肉苁蓉饮片的性状鉴别特征有表面棕褐色或灰棕色，有的可见肉质鳞叶（B对）、切面有点状维管束排列成不规则的波状环纹或成条状而散列（D对）与气微，味甜、微苦（E对）。肉苁蓉：【性状鉴别】饮片肉苁蓉片呈不规则形的厚片（A错）。表面棕褐色或灰棕色（C错）。有的可见肉质鳞叶。切面有淡棕色或棕黄色点状维管束，排列成波状环纹。气微，味甜、微苦。